内科的心身疾病一般不包括
A. 冠心病
B. 高血压
C. 支气管哮喘
D. 肺结核
E. 消化性溃疡

正确答案：D。肺结核

解析：心身疾病是一组与心理社会因素密切相关，但以躯体症状表现为主的疾病，主要特点包括：①心理社会因素在疾病的发生与发展过程中起重要作用；②表现为躯体症状，有器质性病理改变或已知的病理生理过程；③不属于躯体形式障碍。冠心病（A对）、高血压（B对）、支气管哮喘（C对）、消化性溃疡（E对）均可因精神和心理因素而发病。肺结核是肺部感染结核分支杆菌而致病，并非是由于精神心理因素引起（D错，为本题正确答案），因此不属于心身疾病。